上颌尖牙拔除时，最好选择的麻醉方法是
A. 唇、腭侧局部浸润麻醉
B. 腭大孔麻醉
C. 上颌结节组织麻醉
D. 切牙孔阻滞麻醉
E. 下牙槽神经阻滞麻醉

正确答案：A。唇、腭侧局部浸润麻醉

解析：上颌尖牙拔除时，因上牙槽前神经与上牙槽中神经、鼻腭神经与腭前神经多在此交叉，故最好选择唇、腭侧局部浸润麻醉。掌握“颌面部常用局麻法及牙拔除的麻醉选择”知识点。